能激活血浆中LCAT的载脂蛋白是
A. apoAⅠ
B. apoAⅡ
C. apoB
D. apoC
E. apoD

正确答案：A。apoAⅠ

解析：血浆脂蛋白中的蛋白质称为载脂蛋白，主要有apoA、B、C、D及E等五大类。能激活血浆中LCAT的载脂蛋白是apoAⅠ（A对），其可识别HDL受体。apoAⅡ（B错）的主要功能是稳定HDL结构，激活HL；apoB（C错）的主要功能是识别LDL受体，促进CM合成；apoCⅠ（D错）的主要功能是激活LCAT？（对于apoCⅠ能否激活LCAT目前还不能确定），apoCⅡ的主要功能是激活LPL，apoCⅢ的主要功能是抑制LPL、抑制肝apoE受体；apoD（E错）的主要功能是转运胆固醇酯。